亚硝酸盐中毒的特效解毒药物是
A. 二巯基丙磺酸钠
B. 阿托品
C. 美蓝
D. 维生素C
E. 高锰酸钾

正确答案：C。美蓝